警示语为“请仔细阅读药品使用说明书并按说明使用”的药品是
A. 处方药
B. 非处方药
C. 乙类非处方药
D. 甲类非处方药
E. 传统药

正确答案：B。非处方药

解析：本题考查的是非处方药的警示语或忠告语。警示语为“请仔细阅读药品使用说明书并按说明使用”的药品是非处方药（B对）。警示语或忠告语：非处方药标签以及说明书或者包装上必须印有警示语或忠告语：“请仔细阅读药品使用说明书并按说明使用或在药师指导下购买和使用！”。